老年男性患者，76岁诊断为胃癌晚期，膝下无儿无女，只有一80岁老伴陪伴，其老伴身体条件差，无法负担医药费。以下处理措施最恰当的是
A. 积极安乐死
B. 消极安乐死
C. 手术治疗
D. 临终关怀
E. 放弃治疗

正确答案：D。临终关怀

解析：临终关怀的主要对象是晚期恶性肿瘤患者，着重于控制患者疼痛，缓解患者痛苦，消除患者及其家属对于死亡的焦虑和恐惧。临终关怀将临终患者作为服务对象，满足患者生理、心理、伦理和社会全方位需要，使其在舒适的环境中尊严的离世；还关心患者的家属和亲人，使其在患者的临终期及离世后得到慰藉；同时调动社会爱心力量关爱临终患者，使人道精神得到深化和升华（D对）。